医生劝病人“你应该参加一些晨间锻炼”，这种医患关系属于
A. 主动-被动型
B. 指导-合作型
C. 共同参与型
D. 强制-被动型
E. 指导-参与型

正确答案：B。指导-合作型

解析：指导-合作型：这是一种微弱单向、以生物心理社会医学模式为指导思想的医患关系，其特征是“医生教会病人做什么”。在这种医患关系中，医生的作用占优势，同时有限度地调动病人的主动性，也就是说医生是主角，病人是配角。掌握“医患沟通的理论、技术与其应用以及医患关系模式”知识点。